患者瘿肿质软，或大或小，心悸不宁，心烦不寐，目眩手颤，多食消瘦，口干咽燥，恶热多汗，舌红少苔，脉细数其证型是
A. 心肝阴虚
B. 心脾两虚
C. 心胆气虚
D. 心肾阴虚
E. 心阴亏虚

正确答案：A。心肝阴虚

解析：患者瘿肿质软，或大或小，心悸不宁，心烦不寐，目眩手颤，多食消瘦，口干咽燥，恶热多汗，舌红少苔，脉细数其证型是心肝阴虚，用天王补心丸（A对）。心肾阴虚表现为瘿肿质软，目涩目突，手颤，心悸少寐，腰膝酸软，头晕耳鸣，舌质红，苔少，脉细数，用六味地黄汤合黄连阿胶汤（D错）。